卫生保健的公平性是指卫生服务的利用
A. 以市场经济规律为导向
B. 以社会阶层为导向
C. 以收入多少为导向
D. 以支付能力为导向
E. 以需要为导向

正确答案：E。以需要为导向

解析：卫生保健的公平性是指卫生服务的利用以需要为导向（E对）。